某女，35岁。痔疮，大便带血，血色鲜红，时有肛门瘙痒；舌红苔薄黄，脉浮数。宜采用的治法是
A. 清热利湿止血
B. 清热凉血祛风
C. 清热凉血化瘀
D. 理气祛风活血
E. 清热利湿消痔

正确答案：B。清热凉血祛风

解析：本题考查的是痔疮的辨证论治。痔疮，大便带血，血色鲜红，时有肛门瘙痒；舌红苔薄黄，脉浮数。宜采用的治法是清热凉血祛风（B对）。痔是指直肠末端黏膜下和肛管皮肤下的静脉丛发生扩大、曲张所形成的柔软静脉团。临床以便血、脱出、肿痛为特点。根据其发病部位不同，临床可分为内痔、外痔和混合痔。其中，发生于齿状线以上的称为内痔，以便血、痔核脱出以及肛门不适感为临床特点；发生于齿状线之下的称为外痔，以自觉坠胀、疼痛和异物感为主要临床特点；混合痔位于齿状线上下同一点位，表面分别为直肠黏膜和肛管皮肤所覆盖，临床表现具有内痔、外痔的双重症状。西医学中痔疮表现为上述症状者，可参考此内容辨证论治。（一）风伤肠络证：【症状】大便带血，滴血或喷射状出血，血色鲜红，或有肛门瘙痒。舌质红，苔薄白或薄黄，脉浮数。【治法】清热凉血祛风。（二）湿热下注证：【症状】内痔可见便血色鲜红，量较多，肛内肿物外脱，可自行回缩，肛门灼热。外痔可见肛缘肿物隆起，灼热疼痛，咳嗽、行走、坐位均可使疼痛加剧，便干或溏，溲赤。舌质红，苔黄腻，脉弦数。【治法】清热利湿止血（A错）。（三）气滞血瘀证：【症状】内痔常见肛内肿物脱出，甚至嵌顿，肛管紧缩，坠胀疼痛，甚则肛缘水肿、血栓形成，触痛明显。外痔可见肛缘肿物突起，排便时可增大，有异物感，可有胀痛或坠痛，局部可触及硬性结节。舌质暗红，苔白或黄，脉弦或涩。【治法】理气祛风活血（D错）。（四）脾虚气陷证：【症状】肛门松弛，痔核脱出须手法复位，便血色鲜或淡；伴面白少华，少气懒言，纳少便溏。舌质淡，边有齿痕，苔薄白，脉弱。【治法】补气升提举陷。治法为清热凉血化瘀（C错）或清热利湿消痔（E错）的病证，2022年考试指南未明确说明。